断面沾水即呈乳白色隆起
A. 龟甲
B. 地龙
C. 水蛭
D. 僵蚕
E. 蟾酥

正确答案：E。蟾酥

解析：本题考查的是蟾酥的性状鉴别。断面沾水即呈乳白色隆起蟾酥（E对）。蟾酥【性状鉴别】药材断面沾水，即呈乳白色隆起；粉末少许，于锡箔纸上加热即熔成油状。龟甲（A错）【性状鉴别】药材背甲及腹甲由甲桥相连，背甲稍长于腹甲，与腹甲常分离。外表面淡黄棕色至棕黑色，盾片12块，每块常具紫褐色放射状纹理，腹盾、胸盾和股盾中缝均长，喉盾、肛盾次之，肱盾中缝最短；内表面黄白色至灰白色，有的略带血迹或残肉，除净后可见骨板9块，呈锯齿状嵌接；前端钝圆或平截，后端具三角形缺刻，两侧残存呈翼状向斜上方弯曲的甲桥。质坚硬。气微腥，味微咸。以略带血迹、身干、个大、无残肉、洁净者为佳。地龙（B错）【性状鉴别】药材广地龙：呈长条状薄片，弯曲，边缘略卷，长15～20cm，宽1～2cm。体前端稍尖，尾端钝圆，刚毛圈粗糙而硬，色稍浅。雄生殖孔在第18环节腹侧刚毛圈一小孔突上，外缘有数个环绕的浅皮褶，内侧刚毛圈隆起，前面两边有横排（一排或二排）小乳突，每边10～20个不等。体轻，略呈革质，不易折断。气腥，味微咸。水蛭（C错）【性状鉴别】药材蚂蟥：为扁平纺锤形，有多数环节，体长4～10cm，宽0.5～2cm。背部黑褐色或黑棕色，稍隆起，用水浸后，可见黑色斑点排成5条纵纹；腹面平坦，棕黄色；两侧棕黄色。前端略尖，后端钝圆。两端各具一吸盘，前吸盘不显著，后吸盘较大。质脆，易折断，断面胶质状。气微腥。僵蚕（D错）【性状鉴别】药材略呈圆柱形，多弯曲皱缩。长2～5cm，直径0.5～0.7cm。表面灰黄色，被有白色粉霜状的气生菌丝和分生孢子。头部较圆，足8对，体节明显，尾部略呈二分歧状。质硬而脆，易折断，断面平坦，外层白色，中间有亮棕色或亮黑色的丝腺环4个。气微腥，味微咸。以条粗、质硬、色白、断面光亮者为佳。